不受面神经支配的腺体是
A. 腮腺
B. 泪腺
C. 舌下腺
D. 下颌下腺
E. 鼻腔黏膜腺体

正确答案：A。腮腺

解析：不受面神经支配的腺体是腮腺（A对），腮腺由舌咽神经支配。泪腺（B错）、舌下腺（C错）、下颌下腺（D错）、鼻腔黏膜腺体（E错）均由面神经支配。